含有莨菪烷类生物碱的中药是
A. 麻黄
B. 延胡索
C. 洋金花
D. 千里光
E. 雷公藤

正确答案：C。洋金花

解析：本题考查的是中药洋金花的主要化学成分。含有莨菪烷类生物碱的中药是洋金花（C对）。洋金花主要化学成分为莨菪烷类生物碱，由莨菪醇类和芳香族有机酸结合生成的一元酯类化合物。主要有莨菪碱（阿托品）、山莨菪碱、东莨菪碱、樟柳碱和N-去甲莨菪碱。《中国药典》以东莨菪碱为指标成分进行含量测定，要求东莨菪碱不得少于0.15%。麻黄（A错）中含有多种生物碱，以麻黄碱和伪麻黄碱为主，前者占总生物碱的40%～90%，《中国药典》以盐酸麻黄碱和盐酸伪麻黄碱为指标成分进行含量测定，要求药材和饮片含盐酸麻黄碱和盐酸伪麻黄碱的总量不得少于0.80%。此外麻黄还含少量的甲基麻黄碱、甲基伪麻黄碱和去甲基麻黄碱、去甲基伪麻黄碱。延胡索（B错）含有多种苄基异喹啉类生物碱，包括延胡索甲素、延胡索乙素（dl-四氢巴马汀）和去氢延胡索甲素等，这些生物碱的类型为原小檗碱型、原托品碱型、阿朴啡型等六种异喹啉型生物碱，其中多数属原小檗碱型。《中国药典》以延胡索乙素为指标成分进行含量测定，要求含量不得少于0.050%。千里光（D错）中所含有的生物碱主要为吡咯里西啶类生物碱，主要化学成分有千里光宁碱、千里光菲宁碱及痕量的阿多尼弗林碱等；同时含有黄酮苷等成分。《中国药典》以阿多尼弗林碱为指标成分进行限量测定，其中阿多尼弗林碱的含量不得过0.004%。雷公藤（E错）中主要化学成分为雷公藤甲素、雷公藤乙素和雷公藤红素等。其中，雷公藤甲素为二萜类化合物，不是生物碱。